某大型企业计划在自然疫源地兴建旅游建设项目，在征询意见时，有专家提醒，根据《传染病防治法》规定，应当事先由法定单位对该项目施工环境进行卫生调查。该法定单位是
A. 省级以上环境监测评价机构
B. 省级以上疾病预防控制机构
C. 国务院卫生行政主管部门
D. 省级以上环境保护主管部门
E. 省级以上旅游主管部门

正确答案：B。省级以上疾病预防控制机构

解析：在国家确认的自然疫源地计划兴建水利、交通、旅游、能源等大型建设项目的，应当事先由省级以上疾病预防控制机构对施工环境进行卫生调查。建设单位应当根据疾病预防控制机构的意见，采取必要的传染病预防、控制措施。施工期间，建设单位应当设专人负责工地上的卫生防疫工作。工程竣工后，疾病预防控制机构应当对可能发生的传染病进行监测。掌握“传染病的预防”知识点。